女，35岁。某大学教师。3个月前因出国问题与领导争吵，而后逐渐表现出情绪低落，兴趣减退，对未来悲观失望，认为领导和同事都疏远她，常有怨天尤人的表现。能主动求医，接触良好。其主要的情绪反应是
A. 焦虑
B. 恐惧
C. 愤怒
D. 抑郁
E. 痛苦

正确答案：D。抑郁

解析：女性青年患者，3个月前因出国问题与领导争吵（诱因），而后逐渐表现出情绪低落，兴趣减退，对未来悲观失望，认为领导和同事都疏远她，常有怨天尤人的表现（明显心境低落），根据该患者的表现，最主要的情绪反应是抑郁（D对），抑郁的表现可以从闷闷不乐一直到悲痛欲绝，常有兴趣丧失、思维迟缓，自罪感、注意困难、食欲丧失和自杀观念，常伴有失眠、食欲减退或缺失、闭经等，并有其他的认知、行为和社会功能的异常，严重时甚至悲观厌世、自伤和自杀。